治疗消化性溃疡患者上腹部疼痛效果最好的药物是
A. 粘膜保护剂
B. 质子泵抑制剂
C. H₂受体拮抗剂
D. 抗酸药
E. 促动力剂

正确答案：B。质子泵抑制剂

解析：治疗消化性溃疡上腹部疼痛效果最好的药物是质子泵抑制剂， 是治疗消化性溃疡的首选药物 （B对D错），H₂受体拮抗剂（C错）次之；黏膜保护剂（A错）可阻断胃酸和胃蛋白酶对胃粘膜的消化；促动力剂（E错）一般用于消化不良和胃食管反流病的治疗，这四种药物均可缓解上腹部疼痛，但效果不及抗酸药。